属于缓控释制剂的是
A. 硝苯地平渗透泵片
B. 利培酮口崩片
C. 利巴韦林胶囊
D. 注射用紫杉醇脂质体
E. 水杨酸乳膏

正确答案：A。硝苯地平渗透泵片

解析：本题考查缓控释制剂。硝苯地平渗透泵片（A对）为控释制剂；口崩片（B错）为快速释放制剂；脂质体（D错）为靶向制剂。